患者，男，24岁。颈部瘰疬溃口不愈脓水清稀，夹有败絮状物，窦道形成，久治不愈。外治应首选
A. 冲和膏
B. 黑退消
C. 阳和解凝膏
D. 千金散药线
E. 九一丹

正确答案：D。千金散药线

解析：瘰疬，是一种发生于颈部的慢性化脓性疾病，因其结核多枚，累累如串珠，故名瘰疬，相当于西医的颈部淋巴结结核。千金散药线，具有蚀恶肉、化疮腐的作用，用于窦道引流顽肉死腐（D对）。冲和膏，用于初期局部肿块处或中期成脓（A错）。阳和解凝膏掺黑退消，用于初期局部肿块处（BC错）。九一丹,具有提脓去腐的作用，用于一切溃疡流脓未尽者（E错）。